抗恶性肿瘤药的不良反应不包括
A. 消化道反应
B. 增强骨髓造血功能
C. 影响伤口愈合
D. 骨髓抑制
E. 不育

正确答案：B。增强骨髓造血功能

解析：抗恶性肿瘤药的毒性反应①骨髓抑制（D对）：骨髓造血细胞经化疗后外周血细胞数减少的机会取决于细胞的寿命，寿命越短，外周血细胞越容易减少，通常先出现白细胞减少，然后出现血小板降低（C对）（B错，为本题正确答案）②消化道毒性：恶心、呕吐（A对）③脱发④心、肺、肝、泌尿及神经系统的毒性⑤过敏反应⑥第二原发恶性肿瘤⑦引起不育症或致畸胎（E对）。